患者因上前牙有洞要求治疗，无自发痛。查：左右上1近中面龋，探敏，冷测一过性疼痛，去除刺激可缓解，热测同对照牙。诊断为深龋，该牙当日的最佳处理为
A. 氧化锌丁香油糊剂安抚
B. Ca（OH）₂制剂护髓+垫底+光敏树脂充填
C. 光敏树脂充填
D. 玻璃离子水门汀充填
E. 牙髓治疗

正确答案：B。Ca（OH）₂制剂护髓+垫底+光敏树脂充填

解析：患者因上前牙有洞要求治疗，无自发痛。查：左右上1近中面龋，探敏，冷测一过性疼痛，去除刺激可缓解，热测同对照牙。诊断为深龋，该牙当日的最佳处理为Ca（OH）₂制剂护髓，光敏树脂充填（B对）。该患牙为前牙深龋，为保证美观，应选用光敏树脂进行充填治疗；洞底接近髓腔，首先选择氢氧化钙衬洞，以促进修复性牙本质形成，不能直接用光敏树脂充填（C错）会对牙髓产生刺激。患牙热测同对照牙，牙髓状况良好无需氧化锌丁香油糊剂安抚（A错）。玻璃离子水门汀（D错）强度较低，不耐磨，一般不用于恒牙的直接充填。该患牙诊断为深龋，无牙髓病变，不做牙髓治疗（E错）。